肺循环血量增多，并伴左心房左心室血量增多的先心病应是
A. 原发性房间隔缺损
B. 继发性房间隔缺损
C. 动脉导管未闭
D. 室间隔缺损
E. 法洛四联症

正确答案：C。动脉导管未闭

解析：由左心房左心室血量增多可知该患者会出现左心房左心室代偿性增大。左心房左心室以及肺循环血量增多都符合动脉导管未闭的特征，该先心病应诊断为动脉导管未闭（C对）。房间隔缺损的特征是右心房、右心室增大（AB错）、室间隔缺损的特征是左心室、右心室增大（D错）、法洛四联症的特征是右心室增大（E错）。